关于散剂分类和质量要求的说法，错误的是
A. 口服散剂可以直接用水送服
B. 口服散剂一般溶于或分散于水或其他液体中服用
C. 专供治疗、预防和润滑皮肤的散剂也可以称为撒布剂
D. 除另有规定外，中药局部用散剂通过六号筛粉末的重量不得少于90%
E. 用于烧伤治疗的非无菌制剂应在标签上注明“非无菌制剂”

正确答案：D。除另有规定外，中药局部用散剂通过六号筛粉末的重量不得少于90%

解析：本题考查的是散剂的质量要求。除另有规定外，中药局部用散剂通过六号筛粉末的重量不得少于95%（D错，为本题正确答案）。用于烧伤或严重创伤的中药局部用散剂及儿科用散剂按照《中国药典》粒度和粒度分布测定法测定。除另有规定外，中药散剂通过六号筛的粉末重量不得少于95%。散剂系指原料药物或与适宜辅料经粉碎、均匀混合制成的干燥粉末状制剂。散剂按医疗用途分类可分为内服散剂和外用散剂。内服散剂，如川芎茶调散等；外用散剂，如九一散等；专供治疗、预防和润滑皮肤的散剂也可称为撒布剂（C对）或撒粉。散剂用于烧伤治疗，如为非无菌制剂的，应在标签上标明“非无菌制剂”（E对）。内服散剂一般溶解或分散于水或其他液体中服用（B对），亦可直接用水送服（A对）。特殊用法需要根据制剂说明书要求使用。局部用散剂可以采用撒布、调敷、吹入等方式供皮肤、口腔、咽喉、腔道等部位；专供治疗、预防和润滑皮肤的散剂也可称为撒布剂或撒粉。